多孔玻板吸收管采样的流量一般为
A. 0.1～0.5L/min
B. 0.1～1.0L/min
C. 0.5～1.0L/min
D. 1.0～10L/min
E. 28L/min

正确答案：C。0.5～1.0L/min

解析：本题考查多孔玻板吸收管采样的流量。多孔玻板吸收管是一种常用的空气采样工具，它能够有效地收集大气中的有机污染物和气态重金属，并将其转变成固态污染物，从而方便进一步的分析和检测。它由一个玻璃板和一个空气吸收管组成，可以采集空气中的有机污染物和气态重金属等。空气吸收管由一个采样口和一个吸收口组成，采样口处的空气受到一定的吸收压力，流入吸收口，采样气体经过吸收口后，被玻璃板上的活性炭吸附，使采样气体中的污染物被固定在玻璃板上，最终形成一层污染物的沉积。多孔玻板吸收管的采样流量是污染物检测的重要参数，它决定着采样过程中污染物被吸附的比例。一般情况下，流量越大，污染物被吸附的比例越高，反之，流量越小，污染物被吸附的比例越低。多孔玻板吸收管的采样流量一般设定在0.5～1.0L/min（C对ABDE错）之间，这种情况下，一般可以得到较好的采样效果。